引起龈增生的全身性主要因素不包括
A. 月经期
B. 青春期
C. 妊娠性龈炎
D. 过敏性龈炎
E. 苯妥英钠药物性龈炎

正确答案：D。过敏性龈炎

解析：本题考查牙龈疾病。引起龈增生的全身性主要因素不包括过敏性龈炎（D错，为本题正确答案）。龈增生主要指由多种原因引发的以纤维结缔组织增生为主要病理改变的一组疾病，又称增生性龈炎。主要由全身性因素引起（包括月经期、青春期、妊娠性及苯妥英钠药物性龈炎），常常合并有局部菌斑感染，而呈现为炎症性的增生。